吐弄舌的临床意义是
A. 心脾有热
B. 热入心包
C. 虚风内动
D. 阴亏风动
E. 热灼伤阴

正确答案：A。心脾有热

解析：心开窍于舌，脾开窍于口，心脾有热，则出现吐弄舌（A对）。